患者3年来经常心悸、气短。检查：心尖搏动稍向左下移位，心浊音界稍向左下扩大，心尖部听诊可闻及3/6级以上粗糙的收缩期吹风样杂音及舒张期隆隆样杂音。应首先考虑的是
A. 单纯二尖瓣狭窄
B. 单纯二尖瓣关闭不全
C. 二尖瓣狭窄及二尖瓣关闭不全
D. 主动脉瓣狭窄
E. 主动脉瓣关闭不全

正确答案：C。二尖瓣狭窄及二尖瓣关闭不全

解析：本例患者有反复心悸、气短病史，查体可见心尖搏动稍向左下移位，心浊音界稍向左下扩大提示可能出现左心室肥大，心尖部听诊闻及3/6级以上粗糙的收缩期吹风样杂音提示有二尖瓣关闭不全，舒张期隆隆样杂音提示有二尖瓣狭窄，故诊断首先考虑的是二尖瓣狭窄及二尖瓣关闭不全（C对）。单纯二尖瓣狭窄（A错）主要表现为左心房肥大，听诊可闻及心尖区舒张中晚期隆隆样杂音。单纯二尖瓣关闭不全（B错）主要表现为左心室、左心房增大，出现二尖瓣返流，听诊可闻及心尖区收缩期吹风样杂音。主动脉瓣狭窄（D错）主要表现为左心室肥大，听诊可闻及主动脉瓣区收缩中期喷射样杂音。主动脉瓣关闭不全（E错）主要表现为周围血管征阳性，听诊可闻及主动脉瓣区舒张早期叹气样杂音。